洛夏测验作为一种心理测验，其作用的方法是
A. 投射法
B. 问卷法
C. 作业法
D. 观察法
E. 会谈法

正确答案：A。投射法

解析：心理测验根据测验方法分为问卷法、作业法、投射法。投射法测验材料无严谨的结构，如一些意义不明的图像、一片模糊的墨迹或一句不完整的句子，要求受试者根据自己的理解随意作出回答，借以诱导出受试者的经验、情绪或内心冲突。投射法多用于测量人格，如洛夏测验（A对）、TAT等，也有用于异常思维的检测，如自由联想测验、填词测验等。问卷法测验（B错）多采用结构式问题的方式，让被试者以“是”或“否”或在有限的几种选择上作出回答。一些人格测验如MMPI、EPQ及评定量表等都是采用问卷法的形式。作业法测验（C错）形式是非文字的，让受试者进行实际操作。对于婴幼儿及受文化教育因素限制的受试者（如文盲、语言不通的人或有语言残障的人等），心理测验中主要采用这种形式。观察法（D错）和会谈法（E错）是心理评估的方法。